牙本质敏感症对哪种刺激的反应最为显著
A. 冷刺激
B. 热刺激
C. 酸刺激
D. 甜刺激
E. 机械刺激

正确答案：E。机械刺激

解析：本题考查牙本质敏感症。牙本质敏感症以机械刺激（E对）最为显著，其次为冷、酸、甜等，刺激除去后疼痛立即消失。